我国东南地区多用辛凉解表，西北地区则常用辛温解表，所体现的治则是
A. 既病防变
B. 治病求本
C. 因人制宜
D. 因时制宜
E. 因地制宜

正确答案：E。因地制宜

解析：根据不同的地域环境特点，制定适宜治法和方药的原则，称为“因地制宜”不同的地理环境，由于气候条件及生活习惯不同，人的生理活动的病变特点也有区别，所以治疗用药亦应有所差异，如我国西北地区，地势高而寒冷，其病多寒，治宜辛温；东南地区，地势低而温热，其病多热，治宜苦寒（E对）；说明地区不同，患病亦异，而治法亦当有别，即使相同的病证，治疗用药亦当考虑不同地区的特点。